女，23岁。跟邻居吵架时突发剧烈头痛、呕吐，视物双影2小时，伴畏光、恶心、呕吐。查体：右眼睑下垂，右瞳孔散大，对光反射消失，右眼向上、下、内活动受限，颈强直。未明确诊断，首选的检查为
A. 头颅MRI
B. DSA
C. 颈颅多普勒超声
D. 腰椎穿刺
E. 头颅CT

正确答案：E。头颅CT

解析：青年女性患者跟邻居吵架时（可为脑出血诱因）突发剧烈头痛伴呕吐，视物双影2小时伴畏光（颅内压增高表现）。查体：右眼睑下垂，右瞳孔散大，对光反射消失，右眼向上、下、内活动受限（提示患者可能蛛网膜下隙出血压迫视神经或者视放射），颈项强直（脑膜刺激征阳性）。根据患者病史、临床表现及查体，该患者最可能的诊断为蛛网膜下腔出血。头部CT对急性SAH早期显示最清晰，最有价值，应作为首选检查（E对）。头颅MRI（A错）可用于诊断SAH，但因为其价格昂贵，检查速度慢等限制一般不作为首选。数字减影血管造影（DSA）可帮助发现SAH的病因，确定动脉瘤的大小、部位等，一般不作为首选。颈颅多普勒超声（C错），对脑部疾病诊断价值有限。腰椎穿刺（D错）用于SAH伴有颅内压增高的患者时可能诱发脑疝，不作为首选检查。